复凝聚法制备微囊中，37%甲醛溶液作为
A. 凝聚剂
B. 稀释剂
C. 固化剂
D. 增稠剂
E. 分散剂

正确答案：C。固化剂

解析：本题考查复凝聚法制备微囊的制法。复凝聚法制备微囊中，37%甲醛溶液作为固化剂（C对）。复凝聚法的制法：①配制囊材溶液；②药物混悬或乳化：难溶性液体药物（如挥发油）或固体药物，常通过乳化或混悬先分散（E错）于一种囊材溶液（如阿拉伯胶溶液）中；③混合；④凝聚成囊：加适量温水稀释（B错），有助于微囊充盈并避免黏结；⑤胶凝固化：将微囊溶液在搅拌下先放冷至30℃左右，然后在不断搅拌下急速降温至10℃以下（5℃～6℃）使凝聚囊发生胶凝，再加人适量里醛液搅拌一定时间进行交联固化，最后用氢氧化钠液调pH8～9，搅拌一定时间使交联固化完全；⑥洗涤与干燥。